女，58岁。咳嗽、呼吸困难2周余。查体：T36.8℃，右侧肋间隙变宽，右下肺叩诊呈浊音，呼吸音及语音共振明显减弱。该患者肺部病变最可能的情况是
A. 肺不张
B. 肺实变
C. 气胸
D. 肺气肿
E. 胸腔积液

正确答案：E。胸腔积液

解析：患者为中年女性，咳嗽、呼吸困难，右侧肋间隙变宽，右下肺叩诊呈浊音，呼吸音及语音共振明显减弱，根据其临床表现和体征，提示胸腔积液（E对）。肺实变（B错）时叩诊实音，语音共振增强。气胸（C错）、肺气肿（D错）叩诊过清音。肺不张（A错）可有胸闷、气急、呼吸困难、干咳等，胸部体格检查示病变部位胸廓活动减弱或消失，气管和纵膈移向患侧，叩诊呈浊音至实音，呼吸音减弱或消失。